罹患率的定义是
A. （观察期间病例数/同期平均人口数）×1000‰
B. （一年内新发病例数/同年暴露人口数）×1000‰
C. （观察期间新病例数/同期平均人口数）×1000‰
D. （观察期间新病例数/同期暴露人口数）×1000‰
E. （观察期间新老病例数/同期暴露人口数）×1000‰

正确答案：D。（观察期间新病例数/同期暴露人口数）×1000‰

解析：本题考查罹患率的概念。罹患率是测量某人群某病新病例发生频率的指标，公式为：罹患率＝（观察期间新病例数/同期暴露人口数）×1000‰（D对ABCE错）。通常指在某一局限范围短时间内的发病率。